按有效数字修约的规则，以下测量值中可修约为2.01的是
A. 2.005
B. 2.006
C. 2.015
D. 2.016
E. 2.0046

正确答案：B。2.006